用于评价大规模的口腔流行病学指数
A. 牙龈出血、牙菌斑、软垢
B. 龈沟出血、牙周袋、牙石
C. 牙石、软垢、菌斑
D. 牙周袋深度、牙龈出血
E. 菌斑、牙石、牙周袋

正确答案：B。龈沟出血、牙周袋、牙石

解析：本题考查社区牙周指数。用于评价大规模的口腔流行病学指数：龈沟出血、牙周袋、牙石（B对）。社区牙周指数（CPI），是一种操作简单，重复性好，适合大规模口腔流行病学调查的牙周健康状况检查方法。CPI检查即在指数牙上检查牙龈出血，牙周袋深度，牙结石三项内容（ACDE错）。以探诊为主，结合视诊。共检查6个区段，即右上后牙区，上前牙区，左上后牙区，右下后牙区，下前牙区，左下后牙区。检查时以执笔式握持CPI探针，无名指为支点，将探针轻缓地插入龈沟或牙周袋内，探针与牙长轴平行，紧贴牙根。沿牙齿颊（唇）、舌（腭）面龈沟从远中向近中移动，作上下短距离的提插式移动，以感觉龈下结石。同时查看牙龈出血状况，并根据探针上的刻度观察牙周袋深度，CPI探针使用时所用的力不超过20g。